增强桩核固位的方法，除了
A. 尽可能保留残冠硬组织
B. 尽可能利用根管长度
C. 增加桩与管壁的密合度
D. 根管预备成圆柱形
E. 正确使用粘接剂

正确答案：D。根管预备成圆柱形

解析：本题考查增强桩核固位的方法。牙根的形态是从牙颈部向根尖部逐渐变细的锥形，使用柱形桩（D错，为本题的正确答案）必然要磨除过多的根管壁，导致根管侧穿或根折，故现在使用与根管形态一致的锥形桩。尽量保留残存牙体组织（A对）并形成牙本质肩领，可以增加接触面积，增强固位。桩的长度越长，摩擦力与粘固面积越大，固位力越强，所以要尽可能利用根管长度（B对），但是受到牙根总长度的限制，要保证根尖封闭。增加桩与管壁的密合度（C对），可以减少受力时的不稳定，利于固位。粘接力是桩核固位力的重要来源之一，正确使用粘接剂（E对）有利于增强粘接固位。